由于率的抽样误差不可避免，因此根据一定的可信度、理论分布与样本信息推算出来的总体率可能所在的范围为
A. 平均值
B. 标准误的可信区间
C. 标准差的可信区间
D. 方差的可信度
E. 总体率的可信区间

正确答案：E。总体率的可信区间

解析：由于率的抽样误差不可避免，因此需要对总体率进行推测。根据一定的可信度、理论分布与样本信息推算出来的总体率可能所在的范围为总体率的可信区间。掌握“分类资料的统计描述与推断”知识点。